可通过巨噬细胞吞噬作用将所载药物分布于作用部位的被动靶向制剂是
A. 免疫脂质体
B. 前体药物制剂
C. 长循环脂质体
D. 微囊
E. 磁性微球

正确答案：D。微囊

解析：本题考查的是靶向制剂的分类。可通过巨噬细胞吞噬作用将所载药物分布于作用部位的被动靶向制剂是微囊（D对）。被动靶向的微粒经静脉注射后，其在体内的分布首先取决于粒径的大小，小于3μm时一般被肝、脾中巨噬细胞摄取。按照靶向作用方式，靶向制剂可分为：1）被动靶向制剂，即自然靶向制剂。常见的有微囊、微球和脂质体。2）主动靶向制剂，包括前体药物（B错）和经过修饰的药物载体两大类。修饰的药物载体主要有：①修饰的脂质体：如长循环脂质体（C错）、免疫脂质体（A错）、糖基修饰的脂质体；②修饰的微球；③其他，如修饰的微乳、修饰的纳米球等。3）物理化学靶向制剂，主要有：①磁性制剂，如磁性微球（E错）、磁性纳米囊；②栓塞靶向制剂；③热敏靶向制剂；④pH敏感靶向制剂。